女，44岁，坐公交车突然出现心前区发闷、呼吸困难、出汗，觉得自己快不行了，不能自控，要发疯，为此感到紧张害怕，立即被送到医院急诊。未经特殊处理，半小时后症状消失，体格检查正常。最可能的诊断是
A. 惊恐发作
B. 心绞痛
C. 支气管哮喘
D. 分离（转换）性障碍
E. 嗜铬细胞瘤

正确答案：A。惊恐发作

解析：中年女性患者，坐公交车突然出现突然气促，心慌，濒死感，15分钟后自行缓解（惊恐发作典型表现），头颅CT，心电图未见异常（排除其他临床问题），结合患者症状、影像学检查，其最可能的诊断是惊恐发作（A对）。